梦遗健忘，大便干结，口舌生疮，舌红少苔，脉细数者，治疗应选用
A. 天王补心丹
B. 归脾汤
C. 酸枣仁汤
D. 朱砂安神丸
E. 左归丸

正确答案：A。天王补心丹

解析：患者梦遗健忘，大便干结，口舌生疮，舌红少苔，脉细数。由忧愁思虑太过，暗耗阴血，使心肾两亏，阴虚血少，虚火内扰所致。方用天王补心丹。生地黄，入心养血，入肾滋阴，天冬、麦冬滋阴清热；酸枣仁、柏子仁养心安神；当归补血润燥；玄参滋阴降火；茯苓、远志养心安神；人参补气生血，安神益智；五味子安心神；丹参清心活血；朱砂镇心安神；桔梗上行诸药（A对）。归脾汤方证因思虑过度，劳伤心脾，气血亏虚所致。为治疗心脾气血两虚的常用方（B错）。酸枣仁汤方证由肝血不足，阴虚内热而致。为治心肝血虚而致虚烦失眠的常用方（C错）。朱砂安神丸方证因心火亢盛，灼伤阴血所致。为治疗心火亢盛，阴血不足而神志不安的常用方（D错）。左归丸方证因真阴不足，精髓亏损所致。为治疗真阴不足的常用方（E错）。